造成气流受限的病因中，最常出现肺泡弹性回缩力减弱的是
A. 弥漫性泛细支气管炎
B. 支气管扩张
C. 慢性支气管炎
D. 慢性纤维空洞性肺结核
E. 阻塞性肺气肿

正确答案：E。阻塞性肺气肿

解析：慢性支气管炎（P19）进一步发展成阻塞性肺气肿时见肺泡腔扩大，肺泡弹性纤维断裂，故肺气肿较慢性支气管炎弹性回缩力减弱更常见（C错）。支气管扩张（P37）常常是位于段或亚段支气管管壁的破坏和炎性改变，与肺脏弹性回缩力关系不大（B错）。纤维空洞型肺结核（P68）的特点是病程长，反复进展恶化，肺组织破坏重，肺功能严重受损，双侧或单侧出现纤维厚壁空洞和广泛的纤维增生，造成肺门抬高和肺纹理呈垂柳样，患侧肺组织回缩（D错），纵膈向患侧移位，常见胸膜粘连和代偿性肺气肿。肺气肿（P22）病变，导致肺泡对小气道的牵拉力减小，并导致肺泡弹性回缩力减小（E对），copd不可逆，器质性，所以弹性差了 哮喘可逆，功能性，弹性尚可 阻塞性肺气肿→肺泡腔扩大→肺泡弹性纤维断裂→回弹小。